根据《药品经营质量管理规范实施细则》，下列说法中，错误的是
A. 药品零售连锁企业应设置单独的、便于配货活动展开的配货场所
B. 药品零售企业销售药品时，无医师开具的处方不得销售处方药
C. 跨地域连锁经营的药品零售连锁企业质量管理工作负责人，应是执业药师
D. 中药材的每件包装应标明品名、产地、供货单位
E. 储存药品仓库的相对湿度应保持在35%～75%之间

正确答案：E。储存药品仓库的相对湿度应保持在35%～75%之间

解析：本题考查药品的储存与养护。根据《药品经营质量管理规范实施细则》，下列说法中，错误的是储存药品仓库的相对湿度应保持在35%～75%之间（E错，为本题正确答案）。储存药品相对湿度为35%～75%。药品零售企业（含药品零售连锁药店）应具有与所经营药品相适应的营业场所、设备、计算机系统、陈列（仓储）设施设备以及卫生环境；在超市等其他场所从事药品零售活动的，应当具有独立的经营区域（A对）。药品零售企业营业时间内，执业药师或者其他依法经过资格认定的药学技术人员应当在职在岗；未经执业药师审核处方，不得销售处方药（B对）。药品批发和零售连锁企业质量管理工作的负责人：①大中型企业应具有主管药师（含主管药师、主管中药师）或药学相关专业（指医学、生物、化学等专业，下同）、工程师（含）以上的技术职称。②小型企业应具有药师（含药师、中药师）或药学相关专业助理工程师（含）以上的技术职称。③跨地域连锁经营的零售连锁企业质量管理工作负责人，应是执业药师（C对）。《药品管理法》规定，药品包装应当按照规定印有或者贴有标签并附有说明书。同时还规定，发运中药材应当有包装。在每件包装上，应当注明品名、产地、日期、供货单位（D对），并附有质量合格的标志。